听觉传导通路中的第三级神经元位于
A. 上丘
B. 内侧膝状体
C. 下丘
D. 蜗神经节
E. 无

正确答案：C。下丘

解析：听觉传导通路的第1级神经元为蜗神经节内的双极神经细胞。第2级神经元胞体在蜗腹侧核和蜗背侧核内，形成外侧丘系。第3级神经元胞体在下丘核（C对）。第4级神经元胞体在内侧膝状体（B错），发出纤维组成听辐射。